传染病的基本特征不包括
A. 感染后免疫
B. 病原体
C. 流行病学特征
D. 传染性
E. 遗传性

正确答案：E。遗传性

解析：感染后免疫（A对）、病原体（B对）、流行病学特征（C对）、传染性（D对）为传染病四大基本特征，遗传性（E错，为本题正确答案）不属于传染病基本特征。